有约束纵行诸经作用的经脉是
A. 冲脉
B. 任脉
C. 带脉
D. 督脉
E. 跷脉

正确答案：C。带脉

解析：带脉横行绕身一周，约束纵行经脉且带脉有固摄、约束的作用（C对）。冲脉涵蓄十二经气血，故称十二经之海或血海（A错）。任脉总任六阴经，调节全身阴经经气，故称阴脉之海（B错）。督脉总任六阳经，调节全身阳经经气，故称阳脉之海（D错）。跷脉的功能为主司肢体运动，主管眼睑开合（E错）。